女，18岁，突然剧烈头痛呕吐，查体：颈项强直，克氏征阳性，布氏征阳性，CT示侧裂池环池内高密度影，诊断首先考虑
A. 脑炎
B. 脑膜炎
C. 蛛网膜下腔出血
D. 脑肿瘤
E. 脑脓肿

正确答案：C。蛛网膜下腔出血

解析：患者青年女性，突发剧烈头痛呕吐，查体:颈项强直，克氏征（Kerning征）阳性，布氏征（Brudzinski征）阳性，CT示侧裂池环池内高密度影。根据病史和CT检查，考虑诊断为蛛网膜下腔出血（C对）。蛛网膜下腔出血，血液沉积在脑底池和脊髓池中，因此头颅CT可见脑底池和脊髓池可见高密度影；因血液流入蛛网膜下腔刺激痛觉敏感结构引起头痛，颅内容积增加使颅内压增高可加剧头痛；同时因血液刺激软脑膜及软脊膜，可出现脑膜刺激征。脑炎（A错）会有发热、全身不适、头痛、肌痛、嗜睡、腹痛和腹泻等前驱感染症状，起病不突然（P235）。脑膜炎（B错）会有病毒、细菌、结核杆菌等感染症状，CT检查无高密度影的脑出血表现。脑肿瘤（D错）一般慢性起病、无脑膜刺激征。脑脓肿（E错）有明显的起病期、潜伏期、显症期和终期的发病过程，伴有发热、嗜睡、抑郁、全身无力等中毒性表现。